污染创口或为防止积血、积液而放置的引流物的去除时间一般是
A. 手术后6～12小时
B. 手术后12～24小时
C. 手术后24～48小时
D. 手术后36～48小时
E. 手术前24～48小时

正确答案：C。手术后24～48小时

解析：污染创口或为防止积血、积液而放置的引流物，多在24～48小时后去除。掌握“口外手术打结、缝合及外科引流”知识点。